面部的“危险三角区”指的是
A. 口至两侧外眦的三角区
B. 鼻尖至两侧内眦的三角区
C. 鼻翼至两侧口角的三角区
D. 鼻根至两侧口角的三角区
E. 鼻根至两侧鼻翼的三角区

正确答案：D。鼻根至两侧口角的三角区

解析：本题考查面部的“危险三角区”。危险三角区是指鼻根至两侧口角的三角区（D对）。颜面部血液循环丰富,鼻唇部静脉又常无瓣膜，致使在鼻根至两侧口角区域内发生的感染易向颅内扩散，而被称为面部的“危险三角区”。